男孩，2岁。秋季发病。低热伴腹泻2天，为蛋花汤样，10次/天，无腥臭味。粪便常规偶见白细胞。最可能的病原体是
A. 冠状病毒
B. 肠道腺病毒
C. 柯萨奇病毒
D. 诺沃克病毒
E. 轮状病毒

正确答案：E。轮状病毒

解析：患儿，秋季腹泻，腹泻呈蛋花汤样、无腥臭，符合轮状病毒性肠炎的特点，因此该患儿最可能感染的病原体是轮状病毒（E对）。虽然肠道腺病毒也会导致小儿腹泻，但不会出现蛋花汤样腹泻（B错）。冠状病毒一般引起的是上呼吸道感染而不是肠道感染（A错）。柯萨奇病毒是手足口病的病原体（C错）。小儿疾病很少见到诺沃克病毒的感染（D错）。